衬贴肋与肋间内面
A. 肺胸膜
B. 肋胸膜
C. 膈胸膜
D. 纵隔胸膜
E. 胸膜顶

正确答案：B。肋胸膜

解析：肋胸膜衬贴肋与肋间内面（B对）。